急性肺脓肿抗菌治疗的疗程是
A. 4～6周
B. 6～8周
C. 8～12周
D. 12～16周
E. 16～20周

正确答案：B。6～8周

解析：肺脓肿是肺组织坏死形成的脓腔，肺脓肿多合并有厌氧菌的感染，需要用抗生素治疗。肺脓肿抗生素疗程6～8周（B对），如果疗程过后仍不好转，则更换治疗方案。需注意的是，对于肺脓肿抗生素疗程的数据，七九版内科学数据有差异，第七版的数据为8～12周（P38），答题的时候以最新九版内科学为准。